男，50岁。转移性右下腹痛伴发热2天。糖尿病病史10年。查体：T38.5℃，P110次/分，R20次/分，BP130/90mmHg，血常规：WBC19.2X10⁹/L，NO.91。给予补液、抗感染治疗。入院2小时后患者出现腹痛加重伴烦躁不安。T40℃，P132次分，R28次/分，BP75/50mmHg。全腹肌紧张，板状腹。该患者最可能发生的休克是
A. 神经源性休克
B. 心源性休克
C. 失血性休克
D. 感染性休克
E. 过敏性休克

正确答案：D。感染性休克

解析：患者转移性右下腹痛（阑尾炎典型腹痛表现）2天，体温38.5℃（提示发热，正常36.3℃～37.2℃），WBC及中性粒细胞高，入院2小时患者出现腹痛加重伴烦躁不安，查体P132次/分（正常60～100次/分），R28次/分(正常12～20次/分），BP75/50mmHg（＜90/60mmHg，提示休克）；T40℃（提示高热）。全腹肌紧张，板状腹（系阑尾炎穿孔造成腹膜炎临床表现）。结合患者临床表现、病史、查体最可能的诊断是阑尾炎穿孔造成的感染性休克（D对）。